片剂常用的崩解剂有
A. 羧甲基淀粉钠
B. 交联聚维酮
C. 羟丙基纤维素
D. 交联羧甲基纤维素钠
E. 微粉硅胶

正确答案：A、B、D。羧甲基淀粉钠；交联聚维酮；交联羧甲基纤维素钠

解析：本题考查片剂的常用辅料。崩解剂系指促使片剂在胃肠液中迅速破裂成细小颗粒的辅料。常用的崩解剂有：干淀粉、羧甲基淀粉钠（CMS-Na）（A对）、低取代羟丙基纤维素、交联羧甲基纤维素钠（CCMC-Na）（D对）、交联聚维酮（PVPP）（B对）和泡腾崩解剂（碳酸氢钠和枸橼酸组成的混合物，也可以用柠檬酸、富马酸与碳酸钠、碳酸钾、碳酸氢钾）等。羟丙基纤维素（C错）为黏合剂。微粉硅胶（E错）为润滑剂。